人体能量的主要食物来源是
A. 谷类
B. 肉类
C. 蛋类
D. 奶类
E. 豆类

正确答案：A。谷类